下列辅酶含有维生素PP的是
A. FAD
B. NADP⁺
C. CoQ
D. FMN
E. FH₄

正确答案：B。NADP⁺

解析：含有维生素PP的是NADP⁺（B对）和NAD⁺。FAD（A错）、FMN（D错）含有的维生素是维生素B₂。FH₄（E错）含有的维生素是叶酸。CoQ（C错）是一种小分子、脂溶性醌类化合物，是氧化呼吸链中的递氢体。